男孩，8岁。剧烈运动后胸闷，气短1个月。查体：心前区未触及震颤，胸骨左缘2～3肋间闻及3/6级缩期喷射性杂音，P₂增强，固定分裂最典型的心电图改变是
A. 左室高电压
B. 不完全性右束传导阻滞和电轴右偏
C. 左心房肥大
D. 二度房室传导阻滞Ⅰ型
E. 一度房室传导阻滞

正确答案：B。不完全性右束传导阻滞和电轴右偏

解析：根据患儿的杂音特点：胸骨左缘2-3肋间闻及3/6级缩期喷射性杂音、P₂增强固定分裂，应诊断为房间隔缺损。房间隔缺损时，会使右心房前负荷增大，因此心电图会出现不完全性右束传导阻滞和电轴右偏的（B对）。房间隔缺损的主要改变在右心房，对左心室和左心房的影响不大（AC错）。房间隔缺损产生病理改变主要源于产生了左向右的分流，一般没有传到阻滞的情况发生（DE错）。